女，34岁。下腹痛、腹泻、粘液血便6个月。贫血，血沉30mm／h，钡灌肠检查左侧结肠缩短，结肠袋消失，呈“铅管样”
A. 肠易激综合征
B. 肠结核
C. Crohn病
D. 溃疡性结肠炎
E. 结肠癌

正确答案：D。溃疡性结肠炎

解析：中年女性患者，下腹痛、腹泻、黏液血便（黏液血便是溃疡性结肠炎活动期的重要表现）6个月。实验室检查：贫血，血沉增高（女性正常值0～20mm/h），符合中重度溃疡性结肠炎的表现。钡剂灌肠检查：左侧结肠缩短，结肠袋消失，呈“铅管样”（溃疡性结肠炎的特征性表现）。综合该患者的病史、实验室及钡剂灌肠检查，考虑诊断为溃疡性结肠炎（D对）。肠易激综合征（P386）（A错）以腹痛或腹部不适伴排便习惯改变为特征，无黏液脓血便，钡剂灌肠检查无明显改变。肠结核（P368）（B错）包括溃疡型肠结核和增生型肠结核，溃疡型肠结核常伴腹泻，多无脓血，钡剂灌肠检查示回盲部黏膜粗乱，充盈不佳，呈“跳跃征”；增生型肠结核以便秘为主，钡剂灌肠检查示肠腔变窄、肠段缩短变形、回肠和盲肠的正常角度消失。Crohn病（P377）（C错）临床以腹痛、腹泻、体重下降、腹块、瘘管形成和肠梗阻为特点，钡剂灌肠可见肠黏膜皱襞粗乱、纵行性溃疡或裂沟、鹅卵石征等征象。结肠癌（P382）（E错）多发于老年患者，排便习惯与粪便性状改变常为本病最早出现的症状，钡剂灌肠可发现充盈缺损、肠腔狭窄、黏膜皱襞破坏等征象，显示癌肿部位和范围。